天然来源的β-内酰胺酶抑制剂，临床上常与阿莫西林组成复方制剂的药物是
A. 丙磺舒
B. 克拉维酸
C. 舒巴坦钠
D. 他唑巴坦
E. 甲氧苄啶

正确答案：B。克拉维酸

解析：本题考查氧青霉烷类抗菌药。克拉维酸（B对）是天然来源的β-内酰胺酶抑制剂，临床常与阿莫西林组成复方制剂。丙磺舒（A错）为排尿酸的药物,抑制近端肾小管对尿酸的重吸收,并促进肾小管对尿酸排泄。舒巴坦（C错）与氨苄西林可合成β-内酰胺酶抑制剂。他唑巴坦（D错）具有一定的抗菌活性；甲氧苄啶（E错）为抗菌增效剂。